正常成人的血液总量约相当于体重的
A. 0.08
B. 0.15
C. 0.2
D. 0.6
E. 0.4

正确答案：A。0.08